肝病患者使用的利尿药
A. 地高辛
B. 乙胺丁醇
C. 洋地黄毒苷
D. 螺内酯
E. 利福平

正确答案：D。螺内酯